与分解代谢基因活化蛋白（CAP）结合生成复合物的是
A. 乳糖
B. 葡萄糖
C. cAMP
D. 色氨酸
E. 阿拉伯糖

正确答案：C。cAMP